宫颈癌的临床表现不包括
A. 绝经后阴道出血
B. 阴道排液
C. 接触性阴道出血
D. 不孕
E. 血性白带

正确答案：D。不孕

解析：宫颈癌常表现为接触性出血（C对），老年患者常为绝经后不规则阴道流血（A对）；多数患者有白色或血性（E对）、稀薄如水样或米泔状、有腥臭味的阴道排液（B对）。子宫颈癌可合并妊娠，但较少见（P308）（D错，为本题正确答案）。